按计划免疫接种程序，半岁以内需接种的疫苗不包括
A. 白-百-破三联混合疫苗
B. 乙肝疫苗
C. 麻疹疫苗
D. 卡介苗
E. 脊髓灰质炎减毒活疫苗

正确答案：C。麻疹疫苗

解析：白-百-破三联混合疫苗（A对）3个月、4个月、5个月、18个月分别接种一次；乙肝疫苗（B对）需出生时、1个月、6个月分别接种一次；麻疹疫苗（C错，为本题正确答案）出生后8个月接种，半岁以内无需接种；卡介苗（D对）出生时接种；脊髓灰质炎减毒活疫苗2月初种，3月、4月，4岁复种。